男，25岁，工地高空坠落受伤，出现血压下降，腹胀，腹痛。查体见髂骨挤压分离试验阳性，双下肢不等长，会阴部瘀斑。首先考虑的诊断是
A. 股骨颈骨折
B. 股骨干骨折
C. 髋关节脱位
D. 骨盆骨折
E. 脊柱骨折

正确答案：D。骨盆骨折

解析：患者高空坠落后，出现血压下降（提示可能有出血），髂骨挤压分离试验阳性（提示可能为骨盆骨折）、双下肢不等长、会阴部瘀斑（耻骨和坐骨骨折的特有体征），结合患者病史、临床表现和体查，该患者最可能的诊断为骨盆骨折（D对）。股骨颈骨折（A错）多表现为轻度屈髋屈膝及外旋畸形、髋部疼痛等。股骨干骨折（B错）可有大腿中段畸形、反常活动等骨折特有体征。髋关节（C错）前脱位常表现为髋关节屈曲、外展外旋畸形；髋关节后前脱位常表现为患肢缩短、内收内旋或外展外旋畸形。脊柱骨折（E错）除局部疼痛、畸形等骨折表现外，还可伴有感觉或运动障碍等脊髓损伤的表现。